一些外源化学物经生物转化其毒性被增强的现象被称为
A. 代谢解毒
B. 代谢活化
C. 代谢转化
D. 代谢增毒

正确答案：B。代谢活化

解析：本题考查代谢活化。一些外源化学物经生物转化，其毒性被增强的现象被称为代谢活化（B对ACD错）。